患者，男性，23岁。右腮腺区无痛性肿胀3个月，抗感染治疗有效。检查见导管口无红肿，分泌物清亮。该患者应考虑诊断为
A. 流行性腮腺炎
B. 急性化脓性腮腺炎
C. 腮腺淋巴结炎
D. 舍格伦综合征
E. 良性腮腺肥大

正确答案：C。腮腺淋巴结炎

解析：本题考查面颈部淋巴结炎。流行性腮腺炎（A错）为病毒性感染，通常表现为腮腺区肿痛，病情有自限性，约1～2周，分泌液清亮。急性化脓性腮腺炎（B错）为细菌感染，表现为腮腺区肿痛，导管口红肿，有脓性分泌液。腮腺淋巴结炎（C对）病史符合。舍格伦综合征（D错）主要表现为口干，抗感染治疗无效。良性腮腺肥大（E错）主要表现为双侧腮腺肿大，无不适，抗感染治疗无效。